治疗高血压危象选用
A. 心得安
B. 硝普钠
C. 依那普利
D. 可乐定
E. 氢氯噻嗪

正确答案：B。硝普钠

解析：本题考查高血压危象的治疗。治疗高血压危象选用硝普钠（B对）。硝普钠主要用于高血压危象，伴有心力衰竭的高血压患者，也用于外科手术麻醉时控制性降压以及难治性慢性心功能不全。心得安（A错）即普萘洛尔，用于治疗各种程度的原发性高血压，可单独使用，也可与其他抗高血压药合用。依那普利（C错）为血管紧张素酶抑制剂，是伴有左心室肥厚、左心功能障碍、急性心肌梗死、糖尿病肾病的高血压患者的首选药。可乐定（D错）为中枢性降压药，适用于中度高血压。本药不影响肾血流量和肾小球滤过率，能抑制胃肠道腺体分泌和平滑肌运动，故适用于肾性高血压或兼患消化性溃疡的高血压患者。氢氯噻嗪（E错）为噻嗪类利尿药，可单独应用治疗轻度高血压，也常与其他降压药合用以治疗中、重度高血压。